上颌骨骨折块后下移位，预防窒息和急救处理的措施是
A. 紧急从鼻腔插管，保持呼吸道通畅
B. 行紧急气管切开
C. 复位上颌骨折块，利用压舌板等物体颅上颌固定
D. 使用呼吸中枢兴奋剂
E. 维持病人于头低脚高位

正确答案：C。复位上颌骨折块，利用压舌板等物体颅上颌固定

解析：本题考查预防窒息和急救处理的措施。当上颌骨骨折时，骨折块向后下移位，可能引起呼吸道阻塞或误吸，应立即复位上颌骨折块，利用压舌板等物体悬吊上颌骨骨折块，保持气道通畅（C对）。经口明视插管一般在静脉快速诱导，静注肌松剂后进行；经鼻盲探插管法，用于明视经口插管困难者及术后需较长时间机械通气者（A错）。吸入性窒息的急救，应立即行快速气管切开术解除窒息；上颌骨骨折块下移属于阻塞性窒息（B错）。呼吸中枢兴奋剂主要适用于中枢抑制为主、通气不足引起的呼吸衰竭（D错）。昏迷伤员采取俯卧位，口鼻悬空，防止舌后坠，利于唾液外流；一般伤员采取侧卧位，避免分泌物及血凝块堆积在口咽部（E错）。